分子中含苯甲酸胺结构，对5-HT₄受体具有选择性激动作用，与多巴胺D₂受体无亲和力，锥体外系副作用小，耐受性好的胃动力药物是
A. 多潘立酮
B. 舒必利
C. 莫沙必利
D. 昂丹司琼
E. 格拉司琼

正确答案：C。莫沙必利

解析：本题考查莫沙必利。莫沙必利（C对）为胃肠动力药，主要通过激动5-HT₄受体促进Ach释放而发挥胃肠促动力作用。它由西沙必利分子结构优化而来，分子中含苯甲酸胺结构。与多巴胺D₂受体无亲和力，不会出现因多巴胺D₂受体拮抗而引起的锥体外系反应。多潘立酮（A错）为较强的外周性多巴胺D₂受体拮抗剂；舒必利（B错）是一种选择性D₂受体拮抗剂，锥体外系反应轻；昂丹司琼（D错）和格拉司琼（E错）均为拮抗5-HT₃受体的止吐药，都含有吲哚甲酰胺或其电子等排体吲哚甲酸酯的结构。